不适合接受心理治疗的疾病是
A. 焦虑症
B. 恐惧症
C. 精神分裂症急性发作
D. 强迫症
E. 创伤后应激障碍

正确答案：C。精神分裂症急性发作

解析：心理治疗的范围包括综合医院临床各科的心理问题、精神心理科及相关的患者、各类行为问题、社会适应不良，精神心理科及相关的患者是临床应用较早，也是较广泛的领域，包括各类神经症性障碍如焦虑症（A对）、抑郁症、强迫症（D对）、恐怖症（B对）、躯体形式障碍、人格障碍与性心理障碍以及恢复期精神分裂症（C错，为本题正确答案）等，精神分裂症急性发作应以药物治疗控制症状为主。创伤后应激障碍（E对）目前治疗方式包括药物治疗、心理治疗和物理治疗，心理治疗解决患者的实际问题，药物治疗主要针对患者的症状。